对病人自主与医生做主之间关系的正确理解是
A. 病人自主与医生做主是对立的
B. 病人自主与医生做主不是对立的
C. 强调病人自主，也充分看到医生做主的存在价值
D. 强调医生决定，兼顾病人自主
E. 强调病人自主，目的在于减轻医生的责任

正确答案：C。强调病人自主，也充分看到医生做主的存在价值

解析：尊重原则要求尊重患者的自主权、选择的权利，如果患者的选择不当，此时应劝导患者，劝导无效仍应尊重患者或家属的自主权。如果患者的选择会对他人的健康和生命构成威胁或对社会造成严重危害，医务人员对患者选择的限制是符合道德的。掌握“医患关系伦理”知识点。